患者自幼患有痫证，近期发作较频，并见心神不安，心悸，失眠，健忘，舌淡白，脉滑。治疗应选用
A. 竹茹
B. 茯苓
C. 琥珀
D. 党参
E. 远志

正确答案：E。远志

解析：患者自幼患有痫证，近期发作频繁，舌淡白，脉滑治以补益心肾，去痰开窍；心神不安，心悸，失眠，健忘，治以交通心肾、安神定志、益智强识。远志味辛通利，能利心窍，逐痰涎，故可用治痰阻心窍所致之癫痫抽搐、惊风发狂等证，并且远志苦辛性温，性善宣泄通达，既能开心气而宁心安神，又能通肾气而强志不忘，为交通心肾、安神定志、益智强识之佳品（E对）。竹茹具有清热化痰，除烦止呕的功效，可治痰热心烦不寐，没有利窍的功效（A错）。茯苓具有利水渗湿，健脾，宁心的功效，可治痰饮之目眩心悸、心脾两虚、气血不足之心悸，失眠，健忘（B错）。琥珀具有镇静安神，活血散瘀，利尿通淋的功效，可治疗心神不宁，心悸失眠，健忘等症（C错）。党参具有补脾肺气，补血，生津的功效，没有安神益智的功效（D错）。